有关尸检描述不恰当的是
A. 医患双方当事人不能确定死因
B. 尸检可不经死者近亲属同意进行
C. 尸检必须在患者死亡后48小时内进行
D. 医疗事故争议双方当事人可以请法医病理学人员参加尸检
E. 承担尸检任务的机构和病理解剖专业技术人员有进行尸检的义务

正确答案：B。尸检可不经死者近亲属同意进行

解析：患者死亡，医患双方当事人不能确定死因或者对死因有异议的，应当进行尸检。尸检必须在患者死亡后48小时内进行，但具备尸体冻存条件的可以延长至7日。尸检应当经死者近亲属同意并签字，由按照国家有关规定取得相应资格的机构和病理解剖专业技术人员进行。承担尸检任务的机构和病理解剖专业技术人员有进行尸检的义务。医疗事故争议双方当事人可以请法医病理学人员参加尸检，也可以委派代表观察尸检过程。拒绝或者拖延尸检，超过规定时间，影响对死因判定的，由拒绝或者拖延的一方承担责任。掌握“医疗事故处理概述、预防与处置”知识点。